为γ-氨基丁酸的环状衍生物，可促进乙酰胆碱合成的改善脑功能药物的是
A. 盐酸多奈哌齐
B. 利斯的明
C. 吡拉西坦
D. 石杉碱甲
E. 氢溴酸加兰他敏

正确答案：C。吡拉西坦

解析：本替考查脑功能改善药。为γ-氨基丁酸的环状衍生物，可促进乙酰胆碱合成的改善脑功能药物的是吡拉西坦（C对）。吡拉西坦是GABA的衍生物，可促进突触前膜对胆碱的再吸收，影响胆碱能神经元兴奋传递，促进乙酰胆碱合成。盐酸多奈哌齐（A错）、利斯的明（B错）、石杉碱甲（D错）、氢溴酸加兰他敏（E错）均为乙酰胆碱脂酶抑制剂，通过抑制胆碱酯酶活性，阻止乙酰胆碱的水解，提高脑内乙酰胆碱的含量，从而缓解因胆碱能神经功能缺陷所引起的记忆和认知功能障碍。